女，29岁，体重60kg，因感冒发热（T39.3℃），自行多次服用酚麻美敏片、速感宁胶囊（含对乙酰氨基酚、氯苯那敏）、维C银翘片（含对乙酰氨基酚、氯苯那敏、维生素C）。用药3日后出现厌食、恶心、呕吐就诊。检查结果：ALT460U/L，AST560U/L。诊断为药物性肝损伤。可能导致该不良事件的药物成分是
A. 伪麻黄碱
B. 氯苯那敏
C. 右美沙芬
D. 对乙酰氨基酚
E. 维生素C

正确答案：D。对乙酰氨基酚

解析：本题考查对乙酰氨基酚中毒。药物性肝损伤可以出现各种肝脏疾病的表现，药物因素、宿主基因型和患者因素共同决定药物性肝损伤的发生，其中药物因素系由于直接毒性作用和代谢产物所致。对乙酰氨基酚（D对）的活性代谢产物N-乙酰-对苯醌亚胺可与内源性谷胱甘肽结合，并直接损伤肝细胞引起肝细胞坏死，因此具有固有性肝毒性。